新生儿溶血病最常见的是
A. 葡萄糖-6-磷酸脱氢酶缺乏症
B. 球形红细胞增多症
C. MN血型不合
D. Rh血型不合
E. ABO血型不合

正确答案：E。ABO血型不合

解析：ABO血型不合（E对）是新生儿溶血病最常见的病因，多发生在O型血的母亲，而胎儿是A型或B型血的情况。Rh血型不合（D错），MN血型不合（C错）较少见。葡萄糖-6-磷酸脱氢酶缺乏症 （A错）（P333）、球形红细胞增多症 （B错）（P332）、地中海贫血（P335）属于溶血性贫血（P332），而非新生儿溶血病。